最易引起间质性肺炎改变的致病菌是
A. 肺炎链球菌
B. 葡萄球菌
C. 铜绿假单胞（绿脓）菌
D. 克雷伯杆菌
E. 肺炎支原体

正确答案：E。肺炎支原体

解析：肺炎支原体（E对）通常存在于纤毛上皮之间，不侵入肺实质，呈典型的间质性肺炎的病理改变。肺炎链球菌（A错）的致病力是由高分子多糖体的荚膜对组织的侵袭作用，引起肺泡壁的水肿和渗出，累及几个肺段或整个肺叶，呈典型的大叶性肺炎的病理改变。葡萄球菌（B错）的致病物质主要是毒素与酶，呈广泛的融合性的支气管肺炎的病理改变。铜绿假单胞菌（C错）呈弥漫性支气管炎的病理改变。克雷伯杆菌（D错）可引起肺组织坏死、破坏，呈肺叶或肺段实变的病理改变。